体温上升期的热代谢特点是
A. 产热等干散热
B. 散热大于产热
C. 产热大于散热
D. 产热障碍
E. 散热障碍

正确答案：C。产热大于散热

解析：体温上升期时，皮肤血管收缩和血流减少，导致皮肤温度降低和散热减少；同时出现寒战和物质代谢加强，产热增加。因此产热大于散热（C对）是体温上升期的热代谢特点。产热等于散热（A错）是高温期的热代谢特点。散热大于产热（B错）是退热期的热代谢特点。